参苏丸为解表剂，除能益气解表、疏风散寒外，又能
A. 祛痰止咳
B. 宣肺止咳
C. 润燥止咳
D. 降气止咳
E. 敛肺止咳

正确答案：A。祛痰止咳

解析：本题考查的是参苏丸的功能。参苏丸为解表剂，除能益气解表、疏风散寒外，又能祛痰止咳（A对）。参苏丸：【功能】益气解表，疏风散寒，祛痰止咳。桑菊感冒片：【功能】疏风清热，宣肺止咳（B错）。蜜炼川贝枇杷膏：【功能】清热润肺，化痰止咳（C错）。桂龙咳喘宁胶囊：【功能】止咳化痰，降气平（D错）喘。强力枇杷露：【功能】清热化痰，敛肺止咳（E错）。